男，65岁。活动时胸痛1年，加重1个月。查体：胸骨右缘第2肋间可闻及4/6级收缩期喷射性杂音，向颈部传导。该患者最合理的治疗措施是
A. 口服硝酸酯类药物
B. 口服β受体拮抗剂
C. 冠状动脉介入治疗
D. 口服钙通道阻滞剂
E. 主动脉瓣置换术

正确答案：E。主动脉瓣置换术

解析：患者老年男性，活动时胸痛1年（提示心肌缺血），加重1个月。查体可闻及4/6级、向颈部传导的收缩期喷射性杂音（主动脉瓣狭窄典型心脏杂音特点），结合患者临床表现及体征，该患者最可能的诊断是主动脉瓣狭窄。凡出现临床症状者，均应考虑手术治疗，临床以主动脉瓣置换术（E对）为主要手术方法。口服β受体拮抗剂（B错）能减少心肌耗氧量和改善缺血区的氧供需失衡，缩小MI面积，减少复发性心肌缺血、再梗死、室颤及其他恶性心律失常，对降低急性期病死率有肯定的疗效。口服硝酸酯类药物（A错）、β受体拮抗剂（B错）、钙通道阻滞剂（D错）及冠状动脉介入治疗（C错）为治疗冠状动脉粥样硬化性心脏病常用措施。